脑膜中动脉经颅底何部位进人颅腔
A. 圆孔
B. 卵圆孔
C. 棘孔
D. 破裂孔
E. 无

正确答案：C。棘孔

解析：脑膜中动脉经颅底穿棘孔（C对）进人颅腔，分为前、后两支，紧贴颅骨的内面走行，分布于颅骨和硬脑膜。